在通常状况下手术治疗前最重要的伦理原则是
A. 检查周全
B. 知情同意
C. 减轻病人的疑惑
D. 安慰家属
E. 决定手术方式

正确答案：B。知情同意

解析：在接受手术治疗之前，病人有权知晓自己病情及可能的治疗方案，并对医生提出的治疗方案有选择取舍的决定权。在确定采用手术治疗时，必须得到病人及其家属的真正理解和自主同意。知情同意（B对）是病人的基本权利，也是手术治疗前最重要的伦理原则。